患者，男性，35岁。上唇部肿胀疼痛3天，伴发热症状，肿胀的唇部皮肤与黏膜上出现多数的黄白色脓头，破溃后溢出脓血样分泌物，病变区呈紫红色，体温38.5℃。该病变可引起的并发症，除外
A. 海绵窦血栓性静脉炎
B. 败血症
C. 脓毒血症
D. 高热常在39℃以上
E. 颌骨骨髓炎

正确答案：E。颌骨骨髓炎

解析：本题考查面部疖痈。颌骨骨髓炎（E错，为本题正确答案）不属于面部疖痈可引起的并发症。当感染侵入面静脉发生静脉炎及血栓形成时，静脉回流受阻，可出现颜面广泛水肿、疼痛。感染沿无瓣膜面静脉逆行，则引起海绵窦血栓性静脉炎（A对）。全身高热、头痛，直至神志不清。若同时发生脑膜炎、脑脓肿，则出现剧烈头痛、恶心、呕吐、项强直、血压升高、呼吸深缓、惊厥、昏迷等脑膜激惹、颅内高压和颅内占位性病变等体征。细菌随血循环扩散，可引起败血症（B对）或脓毒血症（C对）。高热（常在39℃以上）（D对）呈稽留型或弛张型。